杜仲除了补肝肾强筋骨外，还可
A. 润肠通便
B. 活血
C. 补脾止泻摄唾
D. 安胎
E. 补肺气，定喘嗽

正确答案：D。安胎

解析：本题考查的是杜仲的功效。杜仲除了补肝肾强筋骨外，还可安胎（D对）。杜仲：【功效】补肝肾，强筋骨，安胎。锁阳：【功效】补肾阳，益精血，润肠通便（A错）。骨碎补：【功效】补肾，活血（B错），止痛，续伤。益智仁：【功效】暖肾固精缩尿，温脾止泻摄唾（C错）。蛤蚧：【功效】补肺气，定喘嗽（E错），助肾阳，益精血。